哪一个不属于突发事件的分期
A. 发病前期
B. 潜伏期
C. 暴发期
D. 处理期
E. 恢复期

正确答案：A。发病前期

解析：本题考查突发事件的分期。突发公共卫生事件的分期包括：①潜伏期（B对）；②暴发期（C对）；③处理期（D对）；④恢复期（E对）。发病前期（A错，为本题正确答案）不是突发事件的分期。